蛋白质分子三级结构的稳定因素
A. 氢键、盐键、疏水键和二硫键
B. “S”型
C. 加热
D. 双曲线
E. α-螺旋

正确答案：A。氢键、盐键、疏水键和二硫键

解析：三级结构的形成和稳定主要靠疏水键、盐键、二硫键、氢键和范德华力。掌握“蛋白质结构与功能关系”知识点。